预防慢性氟中毒说法错误的是
A. 预防工业氟污染
B. 净化空气中的氟含量
C. 寻找适宜氟浓度的饮水来源
D. 消除因生活燃煤带来的氟污染
E. 氟浓度较高的水源采取除氟措施

正确答案：B。净化空气中的氟含量

解析：预防慢性氟中毒可从以下3个方面着手：①寻找适宜氟浓度的饮水来源和对含氟浓度较高的水源采取除氟措施；②消除因生活燃煤带来的氟污染；③预防工业氟污染。掌握“氟毒性及氟牙症”知识点。